在合理用药的基本原则中，安全的含义首先是指
A. 使用有毒药物时，应考虑是否适当
B. 使用无毒药物时，应考虑选择合理剂量
C. 应考虑所用药物是否安全，是否会对患者造成不良反应
D. 应考虑用药出现不良反应后，是否另行选药
E. 应考虑用药后如出现意外，是否有相应处理措施

正确答案：C。应考虑所用药物是否安全，是否会对患者造成不良反应

解析：本题考查的是合理用药的基本原则。在合理用药的基本原则中，安全的含义首先是指应考虑所用药物是否安全，是否会对患者造成不良反应（C对）。合理用药的安全原则：所谓安全，即保证用药安全。药物因本身固有的药理学特性在发挥治疗作用的同时，也会对机体产生不同程度的损害或改变病原体对药物的敏感性，甚至产生药源性疾病。因此保证患者用药安全是药物治疗的前提。一名合格的执业药师在建议临床医师或指导患者使用中药或中成药时，必须把保证患者用药安全放在首位。无论所使用的药物是有毒者，还是无毒者，均应首先考虑所用药物是否安全，是否会对患者造成不良反应。同时在用药过程中，还要针对所用药物或出现的意外情况，建议医师或患者采取相应措施，以达到消除或减少药物不良反应之目的。